目前我国所用的狂犬疫苗是
A. 减毒活疫苗
B. 灭活疫苗
C. 基因工程疫苗
D. 多肽疫苗
E. 多糖疫苗

正确答案：B。灭活疫苗

解析：加强对犬等宠物的登记管理，按时注射接种犬用狂犬病灭活疫苗。捕杀野犬或流浪犬也是有效措施。对于如驯犬员、饲养员及兽医等高危人群，应预防接种注射人用狂犬病灭活提纯疫苗，全程3针，有效期2年。掌握“狂犬病、人乳头瘤病毒”知识点。